上颌第一前磨牙的特有解剖标志是
A. 横嵴
B. 斜嵴
C. 近中沟
D. 远中沟
E. 切嵴

正确答案：C。近中沟

解析：本题考查牙体的解剖外形。上颌第一前磨牙的特有解剖标志是近中沟（C对）。横嵴（A错）是下颌第一前磨牙的重要解剖标志，斜嵴（B错）是上颌第一磨牙的解剖特征，远中沟（D错）是上颌第一磨牙、下颌第一磨牙、上颌第二磨牙和下颌第二磨牙的解剖特征。切嵴（E错）是上颌中切牙和下颌中切牙的解剖特征。